砂仁的功效是
A. 化湿行气，温中止泻，安胎
B. 化湿，解暑，止呕
C. 行气，燥湿，消积，平喘
D. 燥湿健脾，祛风湿
E. 燥湿行气，温中止呕

正确答案：A。化湿行气，温中止泻，安胎

解析：砂仁辛能行散，芳香温化，入脾、胃经。善醒脾化湿、行气、温中、止泻，治湿阻中焦、脾胃气滞、寒湿泄泻；能行气和中而安胎，治湿阻寒凝之气滞胎动不安（A对）。化湿，解暑，止呕（B错）是广藿香的功效。行气，燥湿，消积，平喘（C错）是厚朴的功效。燥湿健脾，祛风湿（D错）是苍术的功效。燥湿行气，温中止呕（E错）是草豆蔻的功效。